下列不是蛋白质腐败变质鉴定指标的是
A. 感官指标
B. 物理指标
C. 化学指标
D. 微生物指标
E. 放射性指标

正确答案：E。放射性指标